患儿，3岁。体重14kg，身长86cm。该患儿的生长发育状况为
A. 体重正常，身长偏高
B. 体重正常，身长偏低
C. 体重偏高，身长正常
D. 体重偏高，身长偏低
E. 本重偏低，身长正常

正确答案：B。体重正常，身长偏低

解析：3岁儿童的标准体重（kg）当为=8+2×3=14kg，该3岁患儿体重为14kg，故属于体重正常；3岁儿童的标准身高（kg）当为=7×3+75=96cm，该3岁患儿身长为86cm，故属于身长偏低（A对）。